多巴胺注射液加入5%碳酸氢钠溶液中逐渐变成粉红色属于
A. 药理学的配伍变化
B. 给药途径的变化
C. 适应证的变化
D. 物理学的配伍变化
E. 化学的配伍变化

正确答案：E。化学的配伍变化

解析：本题考查药物的配伍变化。多巴胺注射液与碳酸氢钠注射液配伍后会逐渐变成粉红至紫色，属于化学的配伍变化（E对）。化学配伍变化系指药物之间发生了化学反应，产生沉淀、变色、产气、发生爆炸等现象。